属于舌骨上肌群的是
A. 斜角肌
B. 颈阔肌
C. 茎突舌骨肌
D. 甲状舌骨肌
E. 胸锁乳突肌

正确答案：C。茎突舌骨肌

解析：本题考查舌骨上肌群的解剖特点。属于舌骨上肌群的是茎突舌骨肌（C对）。茎突舌骨肌位于二腹肌后腹的上方并与其平行，为细小的梭状肌。在二腹肌后腹的深侧，肌束起自颞骨茎突，肌纤维斜向前下方，移行于肌腱，止于舌骨大角与体的结合处。在接近止点处，二腹肌中间腱穿过该肌。